生用泻下力较强，久煎泻下力减弱的药是
A. 芒硝
B. 大黄
C. 芦荟
D. 巴豆
E. 郁李仁

正确答案：B。大黄

解析：本题考查的是大黄的用法用量。生用泻下力较强，久煎泻下力减弱的药物是大黄（B对）。大黄：【用法用量】内服：煎汤，一般用5～10g，热结重症用15～20g，散剂减半。外用：适量，研末敷。生大黄泻下作用强，欲攻下者宜生用，入汤剂应后下，久煎则泻下力减弱；亦可用开水泡服，或研末吞服。酒大黄，取酒上行之性，多用于上部火热之证。制大黄，泻下力减弱，活血作用较好，多用于瘀血证或不宜峻下者。大黄炭则凉血化瘀止血。芒硝（A错）：【用法用量】内服：汤剂，10～15g，冲入药汁内或开水溶化；或入丸散。外用：适量，喷撒，漱口，点眼，化水坐浴。芦荟（C错）：【用法用量】内服：2～5g，入丸剂，不入汤剂，或研末装入胶囊服。外用：适量，研末干撒，或调敷。巴豆（D错）：【用法用量】内服：入丸散或装胶囊，0.1～0.3g，不入汤剂。止泻必须炒炭服。外用：适量，研末敷。内服宜制成巴豆霜，以降低毒性。郁李仁（E错）：【用法用量】内服：煎汤，5～12g，生用打碎；或入丸散。